前置胎盘时阴道流血特征是
A. 有痛性阴道流血
B. 宫缩时阴道流血停止
C. 阴道流血量与贫血程度不成正比
D. 阴道流血与外伤有关
E. 无痛性阴道流血

正确答案：E。无痛性阴道流血

解析：前置胎盘时阴道流血特征是无诱因、无痛性反复阴道流血（E对）。胎盘早剥典型症状为妊娠中期突发持续性腹痛，伴或不伴阴道流血，贫血程度与阴道流血量不符，且常有外伤史，ACD均为胎盘早剥的特点（ACD错）。妊娠35周以后，子宫生理性收缩频率增加，前置胎盘出血率随之上升（P128）（B错）。